能够产生焦耳-汤姆逊冷却效应的设备是
A. 球磨机
B. 冲击式粉碎机
C. 滚压式粉碎机
D. 胶体磨
E. 气流式粉碎机

正确答案：E。气流式粉碎机

解析：本题考查气流粉碎机的特点。气流粉碎机（E对）的粉碎有以下特点：（流能磨） ①可进行粒度要求为3～20pm超微粉碎； ②产生焦耳-汤姆逊冷却效应，适用于热敏性物料和低熔点物料粉碎；③可用于无菌粉末的粉碎。